痰热内闭的目态是
A. 戴眼反折
B. 目睛微定
C. 昏睡露睛
D. 双睑下垂
E. 横目斜视

正确答案：B。目睛微定

解析：戴眼反折为目睛固定上视，是太阳病终了的症状（A错）。目睛微定多见于肝风内动，或脏腑精气耗竭，或痰热内闭证（B对）。昏睡露睛多为脾胃虚衰，或吐泻伤津，多见于小儿（C错）。双睑下垂多为先天不足，脾肾亏虚（D错）。横目斜视为目睛固定侧视，多属肝风内动所致（E错）。